流行病学实验具有以下特点
A. 在动物群中进行实验研究，随机分干预组和对照组
B. 同一总体实验人群，随机分干预组和对照组
C. 同一总体中的病例组和对照组，有干预措施
D. 同一总体的暴露人群和非暴露人群，有干预措施

正确答案：B。同一总体实验人群，随机分干预组和对照组

解析：本题考查实验流行病学的特点。实验流行病学的研究对象是来自一个总体的符合纳入排除标准并签署知情同意的人群，通过随机分配形成实验组和对照组（B对ACD错），从而保证实验开始时，两组在有关各方面相当近似或可比，这样实验结果的组间差别才能归之于干预处理的效应。